男，62岁。9天前因食管下段癌，行左侧开胸，今日开始进流食后突发高热，体温39.2度，胸部X线示左侧胸腔液气平面。该患者目前最可能的问题是
A. 反流性食管炎
B. 呼吸道感染
C. 脓胸
D. 吻合口瘘
E. 功能性胃排空障碍

正确答案：D。吻合口瘘

解析：老年男性患者，食管癌术后因进食流食出现高热，体温39.2℃（正常值为36～37℃），提示感染，胸部X线示左侧胸腔液气平面（提示液气胸），结合患者病史、临床表现和影像学检查，该患者目前最可能的问题是吻合口瘘（D对）。反流性食管炎（A错）典型症状为烧心及反流，无发热、胸腔液气平面。呼吸道感染（B错）主要表现为发热、咳嗽、咳痰，不会出现胸腔液气平面表现。脓胸（C错）可有高热、胸腔液气平表现，但一般由气管或食管瘘引起，其发生率没有吻合口瘘高。功能性胃排空障碍（E错）又称术后胃瘫，通常发生在术后2～3天，主要表现为恶心、呕吐，呕吐物多呈绿色。